描述总居住面积与建筑总面积之比用
A. 居住建筑密度
B. 人口净密度
C. 人口毛密度
D. 居住系数
E. 建筑容积率

正确答案：E。建筑容积率

解析：本题考查居住区环境质量评价指标。描述总居住面积与建筑总面积之比用建筑容积率（E对D错）。居住建筑密度（A错）是居住用地内，各类建筑的基底总面积与居住区用地面积的比率。单位住宅用地上居住的人口数量，称为人口净密度（B错）。单位居住用地上居住的人口数量，称为人口毛密度（C错）。